男，31岁。反酸伴上腹胀2个月，胸骨后烧灼样痛3天。最适当的处理措施是
A. 口服阿司匹林，胸痛时舌下含硝酸甘油
B. 冠状动脉造影
C. 食管24小时pH监测
D. 多潘立酮及枸橼酸铋钾口服
E. 口服奥美拉唑

正确答案：E。口服奥美拉唑

解析：本例患者具有典型的反酸和胸骨后烧灼样疼痛的症状，考虑为胃食管反流病，可使用质子泵抑制剂（PPI） 试验性治疗，若症状明显缓解，初步诊断为GERD ，且该病的治疗首选药物为PPI（E对）。口服阿司匹林，胸痛时舌下含硝酸甘油（A错）为心绞痛发作时的急救措施。冠状动脉造影（B错）为冠状动脉粥样硬化性心脏病确诊的方法。食管24小时pH监测（C错）可用于明确食管是否存在过度酸、碱反流。多潘立酮及枸橼酸铋钾口服（D错）可用于轻症GERD或与抑酸药联用辅助用药，但并非首选用药。